关于三角肌的描述，正确的是
A. 位于臂部
B. 受桡神经支配
C. 使肩关节外展
D. 只起于肩胛骨
E. 止于肱骨桡神经沟下方

正确答案：C。使肩关节外展

解析：三角肌位于肩部，而非臂部（A错），起于锁骨外侧1/3，肩峰和肩胛冈，而非只起于肩胛骨。